气雾剂的优点有
A. 能使药物直接到达作用部位
B. 药物密闭于不透明的容器中，不易被污染
C. 可避免胃肠道的破坏作用和肝脏的首关效应
D. 使用方便，尤其适用于OTC药物
E. 气雾剂的生产成本较低

正确答案：A、B、C、D。能使药物直接到达作用部位；药物密闭于不透明的容器中，不易被污染；可避免胃肠道的破坏作用和肝脏的首关效应；使用方便，尤其适用于OTC药物

解析：本题考查气雾剂的优点。气雾剂的优点：能使药物直接到达作用部位（A对）；药物密闭于容器内不易被污染（B对）；避免药物在胃肠道的破坏和肝首过作用（C对）；使用方便，尤其适用于OTC药物（D对）。气雾剂生产成本较高（E错）。